雌激素类药物使用的禁忌症有
A. 乳腺癌
B. 晚期前列腺癌
C. 急性血栓性静脉炎
D. 萎缩性阴道炎
E. 未明确诊断的阴道不规则出血

正确答案：A、C、E。乳腺癌；急性血栓性静脉炎；未明确诊断的阴道不规则出血

解析：本题考查雌激素类药物的禁忌症。雌激素禁用于有乳腺癌（A对）、卵巢癌、急性血栓性静脉炎（C对）及未明确诊断的阴道不规则出血（E对）等患者。晚期前列腺癌（B错）和萎缩性阴道炎（D错）为雌激素的适应证。